泌酸腺壁细胞可分泌
A. 内因子
B. 胃蛋白酶
C. 促胃液素
D. 缩胆囊素
E. 抑胃肽

正确答案：A。内因子